治疗热毒蕴结，咽喉肿痛及肺热咳嗽，应首选的药物是
A. 青黛
B. 贯众
C. 白鲜皮
D. 马齿苋
E. 山豆根

正确答案：E。山豆根

解析：山豆根功善清肺火，解热毒，利咽消肿，为治疗火毒蕴结所致乳蛾喉痹、咽喉红肿疼痛的要药，还可用于治疗齿龈肿痛，口舌生疮，肺热咳嗽（E对）。青黛（A错）主要应用于温毒发斑，血热吐衄，喉痹口疮，痄腮，火毒疮疡，肝火犯肺，胸痛咳血，小儿惊痫。贯众（B错）主要应用于时疫感冒，风热头痛，瘟毒发斑，痄腮，疮疡肿毒等。白鲜皮（C错）治疗湿热疮毒，黄水淋漓，湿疹，风疹，湿热黄疸，尿赤。马齿苋（D错）应用于热毒血痢，痈肿疔疮，丹毒，毒蛇咬伤，便血，痔血，崩漏下血。